某医院心血管内科1985年和1986年死于急性心肌梗塞的病例数分别101人和121人，那么和1985年相比
A. 1986年收治的心肌梗塞病人死亡危险性更大
B. 1986年收治的心肌梗塞病人抢救失败的情况更为严重
C. 心肌梗塞死亡危险的增加不会有统计学意义
D. 所有资料不能判断该科收治的心肌梗塞病人的死亡频率的升降
E. 以上均不对

正确答案：D。所有资料不能判断该科收治的心肌梗塞病人的死亡频率的升降

解析：本题考查病死率的应用。病死率表示确诊某病者的死亡概率。一种疾病的病死率受疾病严重程度、诊断及治疗水平和病原体毒力的影响，随医疗水平、病因、环境和宿主等因素的变化而变化。题中信息较为缺乏，不能判断出该科收治的心肌梗死患者死亡频率的变化（D对ABCE错）。